患者，男，40岁。有机磷中毒经治疗10小时后出现躁动，排尿困难，瞳孔散大，皮肤干燥，心率140次/分，此时患者并发有
A. 肺水肿
B. 阿托品中毒
C. 脑水肿
D. 肾功能不全
E. 心功能不全

正确答案：B。阿托品中毒

解析：有机磷农药中毒后阿托品用量远远超过常规用量，易发生阿托品中毒，出现躁动不安，排尿困难，瞳孔散大，皮肤干燥，心率显著增快（B对）；肺水肿表现为咳嗽、呼吸困难、口唇发绀、大汗淋漓、咳粉红色泡沫痰和喘鸣等（A错）；脑水肿症状有头痛，头晕，呕吐，意识障碍，呼吸、脉搏、血压异常，癫痫等（C错）；肾功能不全临床症状表现为尿检异常、贫血、疲乏无力、体重减轻、尿少或夜尿增多、恶心、酸中毒、浮肿、血肌酐、血尿素氮升高等（D错）；心功能不全临床症状为呼吸困难、乏力、水肿等（E错）。